正常人PAO₂略高于PaO₂的主要原因是
A. 生理性通气/血流比例不协调
B. 功能性死腔增多
C. 功能性分流增多
D. 解剖分流增多
E. 正常静息时仅部分肺泡参与气体交换

正确答案：A。生理性通气/血流比例不协调

解析：生理性的肺泡通气与血流的比例不均衡（A对）是造成正常PaO₂比PAO₂稍低的主要原因。